医学伦理关于尊重原则的叙述，错误的是
A. 尊重原则不包括尊重患者的姓名权荣誉权
B. 实现尊重原则是保障患者根本权益的必要条件
C. 医患双方应该真诚的尊重对方的人格
D. 医务人员应该尊重患者自主
E. 尊重原则的关键是医方对患方的尊重

正确答案：E。尊重原则的关键是医方对患方的尊重

解析：尊重患者的生命，首先，要尽力救治患者，维护其生命的存在，这是对人的生命神圣性的尊重。其次，要通过良好的医疗照护提高患者的生命质量，以维护其生命价值，这是尊重人的人格生命的具体体现。尊重患者作为独特个体的生命存在重视他生命的质量，体悟他因病痛所忍受的痛苦，将减少对患者的身体伤害和缓解痛苦作为伴随患者救治过程的道德主旨。所以，医学伦理关于尊重原则的叙述，尊重原则不包括尊重患者的姓名权荣誉权，实现尊重原则是保障患者根本权益的必要条件、医患双方应该真诚的尊重对方的人格、医务人员应该尊重患者自主（E错，为本题正确答案）。